关于慢性牙髓炎与可复性牙髓炎，以下说法正确的是
A. 两者都可有自发痛史
B. 温度刺激去除后，疼痛立即消失
C. 难以区分时，可先行安抚治疗
D. 都可以有轻度叩痛
E. 以上都对

正确答案：C。难以区分时，可先行安抚治疗

解析：本题考查慢性牙髓炎与可复性牙髓炎的鉴别诊断。关于慢性牙髓炎与可复性牙髓炎正确的是难以区分时，可先行安抚治疗（C对）。可复性牙髓炎是牙髓组织的血管扩张、充血，没有更严重的炎症，所以对于温度、化学刺激会出疼痛反应，尤其是冷刺激；刺激去除后，疼痛立即消失；没有自发痛；叩诊反应同正常对照牙，即叩痛（-）。慢性牙髓炎是牙髓炎症缓慢发展的过程，没有急性牙髓炎发病急，疼痛剧烈，所以一般没有剧烈的自发痛，会有长期的冷热刺激痛史，且热测引起迟缓性痛；曾有过急性发作或者由急性牙髓炎转化而来可有自发痛史；由于炎症多已波及全部牙髓及根尖周膜，患牙会有轻度的咬合不适或轻度的叩痛，即叩痛（+）。因此两者都没有自发痛史（A错）、温度刺激去除后，疼痛立即消失（B错）、都可以有轻度叩痛（D错）的说法都是错误的。当慢性牙髓炎症状不典型难以与可复性牙髓炎区分时，可先行安抚治疗，并持续观察，若一段时间后没有出现任何牙髓炎的临床症状，说明是可复性牙髓炎，去除暂封物进行永久充填即可；若出现牙髓炎的症状，需进行牙髓治疗。这样做可以尽最大可能保留活髓，符合生物学原则。